引起Ⅰ型呼吸衰竭的常见病因是
A. 肺部广泛炎症
B. 慢性支气管炎
C. 慢性阻塞性肺疾病
D. 肺源性心脏病
E. 上呼吸道阻塞

正确答案：A。肺部广泛炎症

解析：呼吸衰竭是指各种原因引起的肺通气和（或）换气功能严重障碍，使静息状态下亦不能维持足够的气体交换，导致低氧血症伴（或不伴）高碳酸血症，进而引起一系列病理生理改变和相应临床表现的综合征。呼吸衰竭按照动脉血气分类，可分为Ⅰ型呼吸衰竭和Ⅱ型呼吸衰竭。Ⅰ型呼吸衰竭是由肺实质或肺血管病变引起的换气功能障碍，肺部广泛炎症（A对）表现为弥漫性肺实质病变，为Ⅰ型呼吸衰竭的常见病因。慢性支气管炎（B错）、慢性阻塞性肺疾病（C错）早期无呼吸衰竭的表现，晚期表现为Ⅱ型呼吸衰竭。肺源性心脏病（D错）是由肺动脉高压导致右心室肥大，表现为Ⅱ型呼吸衰竭。上呼吸道阻塞（E错）属于气道阻塞，造成通气功能障碍，为Ⅱ型呼吸衰竭。